下列哪项属于生理性蛋白尿
A. 肾淤血产生的蛋白尿
B. 肾动脉硬化引起的蛋白尿
C. 体位性蛋白尿
D. 凝溶性蛋白尿
E. 血管内溶血引起的血红蛋白尿

正确答案：C。体位性蛋白尿

解析：生理性蛋白尿是指无器质性病变而出现每日尿蛋白定量超过150mg或尿蛋白/肌酐＞200mg/g，或尿蛋白定性试验阳性，常分为以下两种情况：①功能性蛋白尿，见于剧烈运动、发热、紧张等应激状态所导致的一过性蛋白尿，多见于青少年；②体位性蛋白尿（C对），常见于青春发育期青少年，于直立和脊柱前凸姿势时出现蛋白尿，卧位时尿蛋白消失。肾淤血产生的蛋白尿（A错）、肾动脉硬化引起的蛋白尿（B错）、凝溶性蛋白尿（D错）、血管内溶血引起的血红蛋白尿（E错）均是有器质性病变而引起的蛋白尿，属于病理性蛋白尿。